原植物属于豆科的药材有
A. 苦参
B. 黄芪
C. 番泻叶
D. 决明子
E. 地榆

正确答案：A、B、C、D。苦参；黄芪；番泻叶；决明子

解析：本题考查的是苦参、黄芪、番泻叶与决明子的来源。原植物属于豆科的药材有苦参（A对）、黄芪（B对）、番泻叶（C对）与决明子（D对）。苦参：【来源】为豆科植物苦参的干燥根。黄芪：【来源】为豆科植物蒙古黄芪或膜荚黄芪的干燥根。番泻叶：【来源】为豆科植物狭叶番泻或尖叶番泻的干燥小叶。决明子：【来源】为豆科植物钝叶决明或决明（小决明）的干燥成熟种子。地榆（E错）：【来源】为蔷薇科植物地榆或长叶地榆的干燥根。